正态分布
A. 都是以0为中心的对称分布
B. 变量的取值范围是-3到+3
C. 由均数与方差共同确定
D. 方差大于1
E. 均数小于方差

正确答案：C。由均数与方差共同确定

解析：本题考查正态分布的相关内容。（1）正态曲线曲线形状为单峰、钟形，以均数 µ 为对称轴，左右对称。（2）x=µ时，正态分布概卒密度函数f(x)取得最大值，两边逐渐减少。（3）曲线尾端不与横轴相交。（4）曲线由µ和σ两个参数决定，µ决定曲线的峰值位置，σ决定曲线的形状（C对ABDE错）。